系统综述中最重要的偏倚来源是
A. 选择偏倚
B. 信息偏倚
C. 混杂偏倚
D. 发表偏倚
E. 引用偏倚

正确答案：A。选择偏倚